在运输中应冷库贮存并避免冻结的药品是
A. 促甲状腺素
B. 绒促性素
C. 破伤风人免疫球蛋白
D. 结合雌激素
E. 重组人促红素

正确答案：C。破伤风人免疫球蛋白

解析：本题考查药品的贮存。破伤风免疫球蛋白（C对）在运输过程中遵循运输三原则，即①采用最快速的运输方法，缩短运输时间；②一般应用冷链方法运输；③运输时应注意防止制品冻结。促甲状腺激素（A错）应遮光，密封，在冷处保存。绒促性素（B错）应遮光，密封，在冷处保存。结合雌激素（D错）注射液：一般情况下，配好溶液在数小时内用完。但是，如有必要，可将溶液放置于15～30°C（59～86°F）室温下，避光保存。重组人促红素（E错）在运输中应冷库贮存并避免冻结同时避免振荡。